下列关于女性外阴解剖结构的描述，正确的是
A. 前庭大腺位于大阴唇后部，被球海绵体肌覆盖
B. 阴道前庭有尿道外口、阴道口和肛门
C. 处女膜的表面上皮为柱状上皮
D. 阴蒂分为阴蒂头和阴蒂脚两部分
E. 大阴唇的外侧为皮肤，内侧为黏膜

正确答案：A。前庭大腺位于大阴唇后部，被球海绵体肌覆盖

解析：前庭大腺位于大阴唇后部，被球海绵体肌覆盖（A对）。阴道前庭为一菱形区域，前为阴蒂，后为阴唇系带，两侧为小阴唇，内有前庭球、前庭大腺、尿道外口、阴道口，不包括肛门（B错）。处女膜两面都是鳞状上皮（C错）所覆盖，其间含有结缔组织，血管和神经末梢。阴蒂分为3部分（D错），前为阴蒂头，中为阴蒂体，后为两阴蒂脚。大阴唇外侧面为皮肤，内侧面湿润似黏膜，但不是黏膜（E错）。